有关节盘的关节是
A. 肩关节
B. 肘关节
C. 髋关节
D. 颞下颌关节
E. 无

正确答案：D。颞下颌关节

解析：颞下颌关节（D对）囊内有纤维软骨构成的关节盘。人体中有关节盘的关节有:颞下颌关节、胸锁关节、腕关节、膝关节。